IgG不含的功能区是
A. VH
B. VL
C. CH1
D. CH2
E. CH4

正确答案：E。CH4

解析：Ig通过折叠可形成若干球形结构域，这些结构域是Ig的功能区。轻链有VL和CL两个功能区；IgA、IgG、IgD的重链有VH、CH1、CH2和CH3四个功能区；IgM和IgE重链多一个CH4功能区。掌握“免疫球蛋白基本概念及结构”知识点。